肠易激综合征特征性的临床表现是
A. 腹痛及便血
B. 腹痛或腹部不适伴排便习惯改変
C. 腹胀及里急后重
D. 大便变细
E. 便秘及排便困难

正确答案：B。腹痛或腹部不适伴排便习惯改変

解析：几乎所有肠易激综合征患者都有腹痛或腹部不适伴排便习惯改変（B对），表现为腹泻或便秘，常伴腹胀、排便不尽感。里急后重（C错）为直肠刺激的表现，可出现于细菌性痢疾、溃疡性结肠炎、直肠癌等疾病中，不会出现于肠易激综合征中。大便变细（D错）常为直肠癌的症状。腹痛及便血（A错）常见于肠套叠、溃疡性结肠炎等疾病中。便秘及排便困难（E错）可出现于很多疾病中，不是肠易激综合征特征性的临床表现。